流行性出血热的临床特征是
A. 发热出血腓肠肌疼痛
B. 发热出血皮疹
C. 发热出血低血压肾损害
D. 发热出血昏迷
E. 发热出血低血压肝损害

正确答案：C。发热出血低血压肾损害

解析：临床表现 感染中毒症状、充血、出血、外渗征和肾损害，热退后症状加重。典型患者有发热期、低血压休克期、少尿期、多尿期和恢复期等五期经过，可越期或叠期。流行性出血热的临床特征是发热、出血、低血压、肾损害（C对）。